《环境空气质量标准》中，每个污染物的标准分为三级。二级标准不适用于
A. 风景游览区
B. 居民区
C. 农村地区
D. 商业交通居民混合区
E. 文化区

正确答案：A。风景游览区

解析：本题考查环境空气质量标准的相关内容。《环境空气质量标准》中，二级标准是为保护人群健康和城市、乡村的动、植物，在长期和短期接触情况下，不发生伤害的空气质量要求。适用于居住区（B对）﹑商业交通居民混合区（D对）、文化区（E对）、工业区和农村地区（C对）。一级标准适用于风景游览区（A错，为本题正确答案）。